初产妇第一产程活跃期停滞是指进入活跃期后宫口不再扩张超过
A. 1小时
B. 1小时30分
C. 2小时
D. 4小时
E. 8小时

正确答案：D。4小时

解析：活跃期停滞为活跃期宫口扩张停止＞4小时，故初产妇第一产程活跃期停滞是指进入活跃期后宫口不再扩张超过4小时（D对）。